长期大量使用利福平可出现
A. 恶心
B. 呕吐
C. 腹痛
D. 腹泻
E. 黄疸

正确答案：E。黄疸

解析：肝脏毒性：长期大量使用利福平可出现黄疸、肝肿大、肝功能减退等症状，严重时可致死亡。掌握“异烟肼、利福平及乙胺丁醇”知识点。